单室模型静脉滴注给药过程中体内血药浓度随时间变化的关系式
A. C=k₀（1-e-kt）/Vk
B. lgC＇=（-k/2.303）t＇+lg（k₀/Vk）
C. lgC＇=（-k/2.303）t＇+lg[k₀（1-e-kt）/Vk]
D. lgC=（-k/2.303）t+lgC₀
E. lgX=（-k/2.303）t+lgX₀

正确答案：A。C=k₀（1-e-kt）/Vk

解析：本题考查单室模型静脉滴注给药。C=k₀（1-e-kt）/Vk（A对）是单室模型静脉滴注给药体内血药浓度与时间的关系式；lgC=（-k/2.303）t+lgC₀（D错）是单室模型静脉注射给药体内血药浓度随时间变化关系式；lgX=（-k/2.303）t+lgX₀（E错）是单室模型静脉注射给药体内药量随时间变化关系式。